中药汤剂煎药量应当根据儿童和成人分别确定。儿童每剂汤药一般煎药量为
A. 50～100ml
B. 100～300ml
C. 200～400m
D. 300～500ml
E. 400～600ml

正确答案：B。100～300ml

解析：本题考查的是中药汤剂的煎煮。中药汤剂煎药量应当根据儿童和成人分别确定。儿童每剂汤药一般煎药量为100～300ml（B对）。中药汤剂每剂药的总煎出量为成人400～600ml（E错），儿童100～300ml。